男性，30岁。左下后牙自发性肿痛，吸吮时易出血。自诉5天前曾用牙签剔牙。口腔检查：左下56牙间乳头红肿有明显探触痛，易出血。牙体无龋坏和非龋性疾病。叩诊（+），无松动，未探及牙周袋。可能的诊断是
A. 急性牙髓炎
B. 急性牙周炎
C. 急性根尖周炎
D. 急性龈乳头炎
E. 急性坏死溃疡性龈炎

正确答案：D。急性龈乳头炎

解析：本题考查急性龈乳头炎的病因及临床表现。根据题目中的信息该患者5天前曾用牙签剔牙；左下56牙间乳头红肿有明显探触痛，易出血；牙体无龋坏和非龋性疾病；无松动，未探及牙周袋，可诊断为急性龈乳头炎（D对）。急性牙髓炎的典型特征为自发性阵发性疼痛，可见引起牙髓炎的牙体硬组织损害和其他疾患（A错）。牙周炎有深牙周袋，牙齿松动（B错）。急性根尖周炎叩痛明显，牙齿可有轻微的松动（C错）。急性坏死溃疡性龈炎以龈乳头的坏死为其特征性损害，上覆有灰白色污秽的坏死物，龈缘如虫蚀状，坏死去出现灰白色假膜，易于擦去，龈乳头破坏后与龈缘成一直线，如刀切状，病损不波及附着龈，患处牙龈极易出血，疼痛明显，有典型的腐败性口臭（E错）。